不属于局部振动的操作是
A. 拖拉机驾驶
B. 电锯伐木
C. 建筑灌浆捣固
D. 风钻凿岩
E. 风铲清砂

正确答案：A。拖拉机驾驶